关于胃排空的叙述，正确的是
A. 食物入胃后30分钟开始
B. 大块食物排空快于小颗粒
C. 糖类最快，蛋白质最慢
D. 高渗溶液快于等渗液
E. 混合食物完全排空需4～6小时

正确答案：E。混合食物完全排空需4～6小时

解析：食物由胃排入十二指肠的过程称为胃排空。食物入胃后5分钟左右就开始胃排空（A错），排空速度与食物的物理性状及化学组成有关。液体食物较固体食物排空快，小颗粒食物比大块食物快（B错），等渗液体较非等渗液体快（D错），三大营养物质中糖类食物排空最快，蛋白质次之，脂肪最慢（C错）。混合食物需要4～6小时完全排空（E对）。